按照《药品生产质量管理规范》规定无规定使用期限的物料，其储存期一般不超过
A. 1年
B. 2年
C. 3年
D. 4年
E. 5年

正确答案：C。3年